围绝经期定义
A. 是指妇女从接近绝经时出现与绝经有关的临床特征至绝经后的一段时期
B. 保健的内容有：①合理营养，保持健康的生活态度，保持心情舒畅，注意锻炼身体。②保持外阴部清洁，预防生殖器发生感染。③防治绝经前期月经失调，重视绝经后出血。④由于年老体弱，支持组织及韧带松弛，容易发生子宫脱垂及张力性尿失禁，应进行肛提肌锻炼（用力做收缩肛门的动作），以加强盆底组织的支持力。⑤围绝经期应定期体检，接受妇科及肿瘤普查：早期发现妇科肿瘤。⑥采用激素替代、补充钙剂等综合措施防治围绝经期综合征及骨质疏松的发生
C. 应于绝经1年后取出
D. 国际老年学会规定65岁以后为老年期
E. 保健重点在防治心脑血管疾病、骨质疏松和恶性肿瘤。预防老年妇女发生骨质疏松，应从儿童期开始。冠心病的发生在老年期也明显增多

正确答案：A。是指妇女从接近绝经时出现与绝经有关的临床特征至绝经后的一段时期

解析：本题考查围绝经期定义。围绝经期指妇女从接近绝经时出现与绝经有关的内分泌和临床表现时起至绝经后1年内的期间（A对BCDE错）。